患者，男性，35岁，近日口角区出现一深大溃疡，直径25mm，深及肌层，溃疡周边红肿隆起，扪之基底较硬，边缘整齐。自觉疼痛症状明显，进食困难。该病者可能患有
A. 癌性溃疡
B. 结核性溃疡
C. 创伤性溃疡
D. 重型阿弗他溃疡
E. 坏死性涎腺化生

正确答案：D。重型阿弗他溃疡

解析：本题考查重型阿弗他溃疡的诊断。患者男，35岁，近日口角区出现一深大溃疡，直径25mm，深及肌层（未及骨面），溃疡周边红肿隆起，扪之基底较硬（无肉芽组织），边缘整齐（形态规则）。自觉疼痛症状明显，进食困难（局部淋巴结肿痛）。上述症状，该病者可能患有重型阿弗他溃疡（D对）。重型阿弗他溃疡，好发于青春期，表面有灰黄色假膜或灰白色坏死组织，初始好发于口角，其后有向口腔后部移行的发病趋势，发生于舌腭弓、软硬腭交界处等口腔后部时可造成组织缺损，影响言语及吞咽，常伴低热乏力等全身不适症状和溃疡局部区域的淋巴结肿痛。癌性溃疡（A错）老年人多见，溃疡多不规则，可呈菜花状，边缘外翻，基底出现浸润性硬结，无明显疼痛，病程长，经久不愈或逐渐扩大。结核性溃疡（B错）形态不规则，基底暗红色桑葚样肉芽组织增生，溃疡经久不愈，病理检查见特征性结核结节或结核性肉芽肿。创伤性溃疡（C错）往往有明显的局部刺激因素，且溃疡发生部位及形态与刺激因素吻合，去除刺激后溃疡很快愈合。坏死性涎腺化生（E错）男性多见，溃疡深及骨面，边缘可隆起，底部有肉芽组织，好发于软硬腭交界。